对菟丝子描述正确的是
A. 外表面灰棕色或黄棕色
B. 有香气
C. 两者均是
D. 两者均不是

正确答案：A。外表面灰棕色或黄棕色

解析：本题考查的是菟丝子药材的性状鉴别。菟丝子表面灰棕色或黄棕色（A对）。菟丝子：【性状鉴别】药材呈类球形。表面灰棕色或黄棕色，粗糙，种脐线形或扁圆形。质坚实，不易以指甲压碎。气微（B错），味淡。